上唇是球状突与哪个突起联合形成
A. 额鼻突
B. 中鼻突
C. 侧鼻突
D. 上颌突
E. 下颌突

正确答案：D。上颌突

解析：上颌突自两侧向中线方向生长与球状突融合形成上唇。掌握“面部的发育”知识点。